属于新小脑的是
A. 顶核
B. 齿状核
C. 绒球小结叶
D. 小脑扁桃体
E. 无

正确答案：B。齿状核

解析：齿状核（B对）位于小脑半球的白质内，属于新小脑；顶核（A错）位于第四脑室顶的上方，小脑蛹的白质内，属于原小脑；绒球小结叶（C错）在进化上出现最早，构成原小脑；小脑下面膨隆， 在小脑半球下面的前内侧，各有一突出部，称小脑扁桃体（D错）。